男性，32岁。因发热、腰痛5天，无尿2天以“流行性出血热”入院，经用利尿、纠酸等治疗未见好转，目前烦躁不安，眼脸水肿，体表静脉充盈，脸潮红，血压170/90mmHg，心率120次/分，律齐，应考虑是
A. 肺实质弥漫性出血
B. 高血容量综合征
C. 心力衰竭
D. 尿毒症脑病
E. 高血压脑病

正确答案：B。高血容量综合征